男性，20岁，发热二周，体温38～39℃，检查皮肤散在紫癜，颈部及腋下可触及0.5cm×1.5cm大小淋巴结5～6个，脾肋下3cm，血红蛋白85g/L，白细胞10×10⁹/L，血小板25×10⁹/L。此患者在治疗3周后，出现高热、头痛、呕吐，Kernig氏征（+），应采取治疗方案
A. 应用广谱抗生素
B. 链霉素、雷米封、利福平联合治疗
C. 化疗+鞘内注射MTX
D. 肾上腺糖皮质激素+先锋霉素
E. 输血小板

正确答案：C。化疗+鞘内注射MTX

解析：患者考虑诊断为急性白血病，在治疗3周后，突然出现高热、头痛、呕吐，Kernig征阳性，提示并发中枢神经系统白血病（中枢神经系统是白血病最常见的髓外浸润部位），由于多数化疗药物难以通过血脑屏障，应采取颅脊椎照射或化疗+鞘内注射MTX（C对）。广谱抗生素（A错）、肾上腺糖皮质激素+先锋霉素（D错）主要用于治疗细菌感染性疾病；链霉素、雷米封、利福平联合治疗（B错）主要用于治疗结核性脑膜炎；输血小板（E错）主要用于纠正血小板减少引起的出血。